患儿3岁，近1年多，哭甚时出现青紫，查体：心前区隆起，胸骨左缘第3～4肋间可闻及Ⅳ级收缩期杂音，可触及震颤，X线检查示：左右心室及左房增大，肺血管影增多，肺动脉段凸出。此患儿如决定手术必须做的检查是
A. 心电图
B. 磁共振成像
C. 心功能检查
D. 心导管检查
E. 超声心动图

正确答案：E。超声心动图

解析：由题干分析可知该患儿的诊断为室间隔缺损，而超声心动图（E对）可解剖定位和测量大小，且二维超声可从多个切面显示缺损的直接征象，彩色多普勒超声可显示分流术的起源、部位、数目、大小及方向，频谱多普勒超声可测量分流速度，计算跨隔压差和右心室收缩压，估测肺动脉压等，故在手术前必须做此检查，以明确病变的严重程度及估计预后。心电图（A错）不用于室间隔缺损的确诊，其常用于心律失常的辅助诊断。磁共振成像（B错）常用于软组织显像，利用了水在组织的分布不同的原理。心功能检查（C错）是一个大范围的概念，常包括心肌标记物检查、超声心动图检查等。心导管检查（D错）为有创性检查，临床上一般不用，可进一步证实诊断及进行血流动力学检查。